中毒性肺水肿可用哪一种药物消除泡沫
A. 1/6M乳酸钠
B. 5%碳酸氢钠
C. 10%硅酮或75%酒精
D. 20%甘露醇
E. 50%葡萄糖

正确答案：C。10%硅酮或75%酒精